含钙量高，日服1次的钙制剂的最佳服用时间是
A. 空腹
B. 睡前
C. 餐前
D. 餐后
E. 餐中

正确答案：B。睡前

解析：本题考查药品服用的适宜时间。含钙量高，日服1次的钙制剂的最佳服用时间是睡前（B对）。人血钙水平在后半夜及清晨最低，睡前服用可使钙得到更好的利用。适宜空腹（A错）服用的药物有补益类中药、泻药和某些抗生素等。适宜餐前（C错）服用的药物有胃黏膜保护药和促胃动力药等。适宜餐后（D错）服用的药物有阿司匹林、对乙酰氨基酚和维生素B₁等。适宜餐中（E错）服用的药物有二甲双胍、胰酶和吡罗昔康等。